患儿，7岁。诊断为感染性休克，症见高热，烦躁，精神萎靡，神志昏迷，强直抽搐，喉中痰鸣，胸腹灼热，面色苍白，手足厥冷，口渴喜饮，小便短赤，大便秘结，色红，苔黄燥，脉细数。其中医证型是
A. 气阴亏虚
B. 心阳虚衰
C. 阴竭阳脱
D. 肝肾阴虚
E. 热毒内闭

正确答案：E。热毒内闭

解析：感染性休克热毒内闭证症状：高热，烦躁，或精神萎靡，甚则神志昏迷，强直抽搐，喉中痰鸣，胸腹灼热，口渴喜饮，面色苍白，手足厥冷，小便短赤，大便秘结，舌红，苔黄燥，脉数，宜清热解毒，通腑开窍。清瘟败毒饮合小承气汤加减（E对）。气阴亏竭证症状：神志不清，面色苍白，呼吸促而弱，皮肤干燥，尿少口干，四肢厥冷，唇舌干绛，苔少而干，脉细数而无力。治法：益气养阴，救逆固脱。方药：生脉散加减（A错）。心阳虚衰表现为心悸怔忡，形寒肢冷，肢体浮肿，小便不利，神疲乏力，腰膝酸冷，唇甲青紫，舌淡紫，苔白滑，脉弱（B错）。阴竭阳脱证症状：神志不清，面色青灰，皮肤紫花或大片瘀斑，体温不升，皮肤湿冷，四肢冰凉过肘膝，汗出如油，呼吸不整，唇紫发青，苔白滑，脉微欲绝，或指纹淡隐。治法：益气回阳，救逆固脱。方药：参附汤或参附龙牡救逆汤加减（C错）。肝肾阴虚证表现为头晕目眩，耳鸣健忘，失眠多梦，腰膝酸软，胁肋胀痛，口燥咽干，五心烦热，颧红盗汗，男子遗精，女子经少，舌红少苔，脉细数等（D错）。